既可作为栓剂增稠剂，又可作为O/W软膏基质稳定剂的是
A. 白蜡
B. 聚山梨酯80
C. 叔丁基对甲酚
D. 单硬脂酸甘油酯
E. 凡士林

正确答案：D。单硬脂酸甘油酯

解析：本题考查栓剂的附加剂。单硬脂酸甘油酯（D对）既可作为栓剂增稠剂，又可作为O/W软膏基质稳定剂；白蜡（A错）能作为栓剂的硬化剂；聚山梨酯80（B错）可作为栓剂的吸收促进剂；叔丁基对甲酚（C错）可作为栓剂的抗氧化剂；凡士林（E错）一般作为软膏剂的油性基质。